在慢支的病因中最易导致黏液、纤毛清除功能障碍的是
A. 气候
B. 吸烟
C. 理化因素
D. 感染因素
E. 过敏因素

正确答案：B。吸烟

解析：慢性支气管炎的病因有吸烟、职业粉尘和化学物质、空气污染、感染因素等。其中最重要的因素是吸烟，烟草中的焦油、尼古丁等化学物质具有多种损伤效应，如损伤气道上皮细胞和纤毛运动，使气道净化能力下降；促使支气管黏液腺和杯状细胞增生肥大，黏液分泌增多（B对）；刺激副交感神经而使支气管平滑肌收缩，气道阻力增加；使氧自由基产生增多，诱导中性粒细胞释放蛋白酶，破坏肺弹力纤维，诱发肺气肿形成等。气候（A错）、理化因素（C错）与慢性支气管炎的发生发展有关，不是主要导致慢支的因素。感染因素（D错）可造成气管和支气管黏膜的损伤和慢性炎症。过敏因素（E错）为支气管哮喘的发病因素之一。